较严重的不良反应较难恢复，称为
A. 药源性疾病
B. 毒性反应
C. 后遗效应
D. 特异质反应
E. 药物不良反应

正确答案：A。药源性疾病

解析：较严重的不良反应较难恢复，称为药源性疾病。掌握“药物不良反应”知识点。